腋神经损伤后可导致
A. 臂不能后伸
B. 臂不能前屈
C. 臂不能内收
D. 臂不能外展
E. 臂不能内旋

正确答案：D。臂不能外展

解析：腋神经支配三角肌和小圆肌，损伤后此二肌瘫痪，表现为臂不能外展（D对），肩部和臂外上部皮肤感觉障碍。